以下情形中，应该填写《药品不良反应/不良事件报告》的有
A. 小儿误服成人降糖药后，出现低血糖
B. 上市5年内的新药，患者服用后出现呕吐
C. 嚼碎服用缓释片，出现心率过缓
D. 使用外用贴剂后出现剥脱性皮炎，入院治疗
E. 漏服高血压药后，血压控制不佳

正确答案：B、D。上市5年内的新药，患者服用后出现呕吐；使用外用贴剂后出现剥脱性皮炎，入院治疗

解析：本题考查药品不良反应。应该填写《药品不良反应/不良事件报告》的有：上市5年内的新药，患者服用后出现呕吐（B对）、使用外用贴剂后出现剥脱性皮炎，入院治疗（D对）。药品不良反应是指合格药品正常用法用量下出现的与用药目的无关的有害反应。小儿误服（A错）、嚼碎服用缓释片（C错）、漏服高血压药（E错）均不属于药品不良反应范围。